某些根尖周炎的患者在抵抗力强，感染轻微的低度刺激下，可呈现修复性反应，对于此反应的描述错误的是
A. 根尖牙骨质吸收处重新沉积
B. 骨小梁增生，骨髓腔缩小
C. 骨髓被纤维组织取代
D. 牙骨质在根面被吸收
E. X线片显示阻射区与周围正常骨分界不清

正确答案：D。牙骨质在根面被吸收

解析：本题考查急慢性根尖周炎。牙骨质在根面被吸收（D错，为本题正确答案）不是根尖周炎的修复性反应。致密性骨炎属于牙齿慢性根尖周炎的修复性反应。表现为炎症减轻，吸收处骨质重新沉积，骨小梁增生，骨髓腔缩小，骨髓被纤维组织取代。与此同时牙骨质也可在根面沉积，产生牙骨质过度增生。X线片可见修复区域周围正常骨分界不清。